白喉杆菌主要致病物质是
A. 类毒素
B. 菌毛或荚膜等菌体结构
C. 内毒素
D. 外毒素
E. 侵袭性酶类

正确答案：D。外毒素